氟排泄的主要途径是
A. 肾
B. 肝
C. 脾
D. 肺
E. 血液

正确答案：A。肾

解析：肾脏是氟排泄的主要途径。掌握“人体氟摄入及代谢、氟防龋”知识点。